普查的优点是
A. 适合患病率较低疾病的调查
B. 调查的精确性高，不容易出现漏查
C. 可以很快获得疾病的发病率资料
D. 确定调查对象比较简单
E. 统一的调查技术可以有效保证调查质量

正确答案：D。确定调查对象比较简单